下列不属于特殊型胃癌的是
A. 未分化癌
B. 鳞状细胞癌
C. 腺鳞癌
D. 类癌
E. 印戒细胞癌

正确答案：E。印戒细胞癌

解析：WHO近年将胃癌分为：腺癌（包括乳头状腺癌、管状腺癌、黏液腺癌、印戒细胞癌（E）和混合型腺癌）、腺鳞癌（C）、鳞状细胞癌（B）、类癌（D）、未分化癌（A）以及未分类癌。其中腺癌为最常见的组织学类型，其余均为特殊型胃癌。由于印戒细胞癌（E对）属于胃腺癌，故不属于特殊型胃癌。